汉坦病毒主要引起的疾病是
A. Q热
B. 恙虫病
C. 肾综合征出血热
D. 流行性乙型脑炎
E. 森林脑炎

正确答案：C。肾综合征出血热